铜绿假单胞菌性尿道炎的首选药为
A. 环丙沙星
B. 氧氟沙星
C. 诺氟沙星
D. 左氧氟沙星
E. β-内酰胺类

正确答案：A。环丙沙星

解析：泌尿生殖道感染：环丙沙星、氧氟沙星与β-内酰胺类同为首选药。环丙沙星是铜绿假单胞菌性尿道炎的首选药。氟喹诺酮类对敏感菌所致的急、慢性前列腺炎以及复杂性前列腺炎，均有较好效果。掌握“喹诺酮类”知识点。